初孕妇，妊娠37+2周，基础血压不高。近5天头痛、眼花，血压160/100mmHg（21.3/13.3kpa）蛋白（++），尿雌激素/肌酐值为11，胎心148次/分，此时如何处理最恰当
A. 积极治疗终止妊娠
B. 积极治疗，等待自然分娩
C. 立即行剖宫产术
D. 积极治疗至妊娠38周时终止妊娠
E. 静脉滴注催产素引产

正确答案：A。积极治疗终止妊娠

解析：有妊高征的症状近5天头痛、眼花，BP160/100mmHg，尿蛋白（+++），但是胎儿情况良好，积极治疗尽快终止妊娠。掌握“娠期高血压疾病”知识点。